某医生为自己开麻醉药处方，以达滥用目的
A. 没收全部麻醉药品和非法所得、罚款或停业整顿
B. 以生产、贩卖毒品论处
C. 以生产、贩卖毒品论处
D. 给予行政处分
E. 判二年以下徒刑

正确答案：D。给予行政处分

解析：本题考查执业医师的法律责任。某医生为自己开麻醉药处方，以达滥用目的应给予行政处分（D对）。根据《麻醉药品和精神药品管理条例》第七十三条第一款规定，具有麻醉药品和第一类精神药品处方资格的执业医师违反规定开具相关处方，或未按临床应用指导原则使用麻醉药品和第一类精神药品的，由其所在医疗机构取消其麻醉药品和第一类精神药品处方资格，造成严重后果的，由原发证机关吊销其执业证书。执业医师未按照临床应用指导原则的要求使用第二类精神药品或者未使用专用处方开具第二类精神药品，造成严重后果的，由原发证部门吊销其执业证书。